何者错误
A. 通过枕骨大孔下接脊髓
B. 位于小脑的腹侧
C. 上接间脑
D. 分为延髓、脑桥、中脑三部分
E. 全部脑神经连于其上

正确答案：E。全部脑神经连于其上

解析：脑干自下而上分为延髓、脑桥、中脑三部分（D对），上接间脑（C对），向下通过枕骨大孔与脊髓相接（A对），位于小脑的腹侧（B对）。脑干表面附有第III-XII对脑神经根（E错，为本题正确答案）。